下列关于血栓性深静脉炎主要临床表现的叙述，错误是
A. 患肢疼痛
B. 肿胀
C. 肤温度升高
D. 足背动脉搏动减弱
E. 浅静脉扩张

正确答案：D。足背动脉搏动减弱

解析：足背动脉搏动减弱多由于动脉灌注不足所导致，可由动脉本身的病变或由于合并其它疾病导致动脉发生病变所致，血栓性深静脉炎累及的是深静脉并非动脉，其足背动脉搏动不会减弱（D错，为本题正确答案）。血栓性深静脉炎病理变理化为血管内膜增生，管腔变窄，血流缓慢，从而静脉回流及周围循环受阻，导致静脉淤滞和组织灌注量不足，会出现患肢疼痛、肿胀、浅静脉扩张、皮肤温度升高（ABCE错）。